以下不是乳牙龋齿特点的是
A. 自觉症状不明显容易忽视
B. 龋蚀多发广泛
C. 静止龋中以环状龋为主
D. 发病时间早，5～8岁达高峰
E. 龋齿进展快

正确答案：C。静止龋中以环状龋为主

解析：本题考查乳牙龋的患病特点。以下不是乳牙龋齿特点的是静止龋中以环状龋为主（C错，为本题正确答案）。乳牙在临床上可表现为急性龋和慢性龋，湿性龋和干性龋。乳牙以急性龋和和湿性龋多见。环状龋属于活动龋的范畴。乳牙龋的患病特点主要有：1.患龋率高,发病时间早，5～8岁达高峰（D对）；2.龋发展速度快（E对）；3.自觉症状不明显，易忽略（A对）；4.龋齿多发，龋损范围广（B对）；5.修复性牙本质形成活跃。